按照中国居民平衡膳食宝塔的要求，每天鱼禽、肉、蛋等动物性食物的摄入量应为
A. 25～30g
B. 40～75g
C. 75～120g
D. 120～200g
E. 250～400g

正确答案：D。120～200g

解析：本题考查中国居民平衡膳食宝塔要求每天鱼禽、肉、蛋等动物性食物的摄入量。按照中国居民平衡膳食宝塔的要求，每天鱼禽、肉、蛋等动物性食物的摄入量应为120～200g（D对ABCE错），其中畜禽肉40～75g、水产品40～75g、鸡蛋l个（50g左右）。